急性根尖周炎疼痛缓解时的病理特点是脓肿
A. 位于牙槽窝内
B. 达黏膜下
C. 达骨膜下
D. 位于牙槽窝和牙槽骨
E. 位于牙周膜内

正确答案：B。达黏膜下

解析：本题考查急性化脓性根尖周炎的3个阶段。急性根尖周炎是从根尖部牙周膜出现浆液性炎症到根尖周组织形成化脓性炎症的一系列反应过程，是一个病变程度由轻到重，病变范围由小到大的连续过程。可分为3个阶段，即根尖周脓肿、骨膜下脓肿及黏膜下脓肿，形成黏膜下脓肿时，由于黏膜下组织较疏松，脓液到达黏膜下（B对）时，压力已大为减低，急性根尖周炎疼痛缓解。当脓肿达骨膜下（C错）时，由于骨膜坚韧，局部压力大，疼痛达到最高峰。当脓肿位于牙槽窝内（A错）及位于牙槽窝和牙槽骨（D错）时为根尖周脓肿，此时患牙出现自发痛、剧烈的跳痛及咬合痛等，叩痛症状明显。脓肿位于牙周膜内（E错）即脓肿处于根尖周牙周膜，此时患牙出现自发性、剧烈持续的跳痛，伸长感加重，以至咬合时首先接触患牙并引起剧痛，患者因而不敢咬合，此时疼痛尚未得到缓解。